患者，女，38岁，诊断为带状疱疹。需要缓慢加至有效剂量的口服镇痛药物是
A. 利多卡因
B. 伐昔洛韦
C. 甲钴胺
D. 加巴喷丁
E. 喷昔洛韦

正确答案：D。加巴喷丁

解析：本题考查带状疱疹的药物治疗。加巴喷丁（D对）起始剂量为300mg/d，常用有效剂量为900～1800mg/d；呈非线性药代动力学特点，生物利用度随剂量升高而降低，个体间变异率为20%～30%，疗效存在封顶效应；主要不良反应为嗜睡和头晕，起始用药后需要数周缓慢滴定至有效剂量；该药物主要以原型经肾排泄，肾功能不全患者应减量。